拇指腕掌关节的说法，不正确的是
A. 由大多角骨与第1掌骨底构成
B. 属鞍状关节
C. 关节囊松弛
D. 仅能作对掌运动
E. 能作环转运动

正确答案：D。仅能作对掌运动

解析：拇指腕掌关节是由大多角骨和第1掌骨底构成（A对）的鞍状关节（B对），关节囊厚而松弛（C对），可以做屈、伸、收、展、环转（E错）和对掌运动（D错，为本题正确答案）。